服用异烟肼，慢乙酰化型患者比快乙酰化型患者更易发生
A. 溶血性贫血
B. 系统性红斑狼疮
C. 血管炎
D. 急性肾小管坏死
E. 周围神经炎

正确答案：E。周围神经炎

解析：本题考查影响药物的作用因素。周围神经炎（E对）是服用异烟肼时，慢乙酰化型患者比快乙酰化型患者更易发生的不良反应。某些患者遗传性葡萄糖-6-磷酸脱氢酶缺乏，当其服用某些药物时可引起溶血性贫血（A错）；系统性红斑狼疮（B错）是在遗传因素、环境因素、雌激素水平等各种因素相互作用下引起的机体多系统损害；血管炎（C错）是血管壁及血管周围有炎细胞浸润，并伴有血管损伤；急性肾小管坏死（D错）为急性肾衰的一种，是各种病因所引起的肾组织缺血及/或中毒性损害导致肾小管上皮细胞损伤或坏死，因而肾小球滤过率（GFR）急剧降低而出现的临床综合征。